以下胶囊剂的特点，哪项描述有误是
A. 外观光洁，美观，且可掩盖药物的不良气味，便于服用
B. 与片剂、丸剂相比，在胃肠道中崩解较快，故显效也较快
C. 制成定时定位释放药物的制剂
D. 药物生物利用度低
E. 药物被装于胶囊中，与光线、空气和湿气隔离

正确答案：D。药物生物利用度低

解析：本题考查胶囊剂的特点。以下胶囊剂的特点，哪项描述有误是药物生物利用度低（D错，为本题正确答案）。胶囊剂特点：胶囊剂系指原料药物或与适宜辅料充填于空心胶囊或密封于软质囊材中制成的固体制剂。胶囊剂的特点：①能掩盖药物的不良气味，减小药物的刺激性，便于服用（A对）。②与片剂、丸剂比较，在胃肠道中崩解、溶出快，吸收好，起效快（B对），生物利用度高。③药物充填于胶囊中，与光线、空气和湿气隔绝（E对），可提高药物稳定性。④制成不同释药速度和释药方式的胶囊剂，可定时定位释放药物（C对）。